甲状腺功能亢进症手术治疗的适应症是
A. 中度甲亢内科治疗无效者
B. 青少年患者
C. 甲状腺度I度肿大
D. 症状较轻者
E. 合并不稳定型心绞痛者

正确答案：A。中度甲亢内科治疗无效者

解析：甲状腺功能亢进症手术指症为继发性甲亢或高功能腺瘤，中度以上的原发性甲亢，腺体较大伴有压迫症状或胸骨后甲状腺肿等类型甲亢，保守治疗无效，如抗甲状腺药物或¹³¹I治疗后复发者或坚持长期用药有困难者（A对），妊娠早、中期的甲亢病人。青少年和老年病人（B错）、症状较轻（D错）或者合并严重心、肺等器质性疾病（E错）者往往视为手术禁忌症。